女，26岁。产前检查发现子宫肌瘤直径2cm。足月顺产后，阴道流血淋漓2月余，前日妇科检查子宫如孕10周，均匀增大。血hCG阳性。此病例最大可能是
A. 子宫复旧差
B. 子宫内膜炎
C. 妊娠滋养细胞疾病
D. 肌瘤变性
E. 月经不调

正确答案：C。妊娠滋养细胞疾病

解析：该患者产前检查发现子宫肌瘤直径2cm。足月顺产后，阴道流血淋漓2月余（妊娠滋养细胞肿瘤常见于葡萄胎排空后或流产、足月分娩、异位妊娠后出现阴道流血），妇科检查子宫如孕10周，均匀增大（妊娠滋养细胞肿瘤常于产后子宫未恢复到正常大小，而表现为子宫增大），血hCG阳性（妊娠滋养细胞肿瘤常在足月产后超过4周血hCG仍为阳性，或一度下降后又上升）。结合患者的临床表现，可诊断为妊娠滋养细胞疾病（C对）。子宫复旧差（A错）主要表现为血性恶露持续时间延长，但无子宫增大及血hCG阳性的表现。子宫内膜炎（B错）常见症状为下腹痛、阴道分泌物增多，无子宫增大及血hCG阳性的表现（P227）。妊娠期或产褥期的肌瘤变性（D错）多为红色样变，患者可有剧烈腹痛伴恶心、呕吐、发热，虽可子宫增大，但无血hCG为阴性，与该患者的临床表现不符合（P311）。月经不调（E错）可出现阴道流血淋漓，但无子宫增大及血hCG阳性的表现。